酸性最强的蒽醌类衍生物中含有的基团是
A. 2个α-OH
B. 3个α-OH
C. 2个β-OH
D. 1个-COOH
E. 3个β-OH

正确答案：D。1个-COOH

解析：本题考查的是蒽醌类衍生物的酸碱性。酸性最强的蒽醌类衍生物中含有的基团是1个-COOH（D对）。蒽醌类衍生物多具有酚羟基，故具有酸性，易溶于碱性溶剂。分子中酚羟基的数目及位置不同，酸性强弱也不一样。蒽醌类衍生物酸性强弱的排列顺序为：含-COOH＞含两个以上β-OH（CE错）＞含一个β-OH＞含两个以上α-OH（AB错）＞含一个α-OH。